只有一种核酸类型的微生物是
A. 螺旋体
B. 衣原体
C. 病毒
D. 细菌
E. 真菌

正确答案：C。病毒